外源性支气管哮喘，与浆细胞产生的使人致敏的抗体结合的细胞是
A. 嗜酸性粒细胞
B. 单核细胞
C. 淋巴细胞
D. 嗜碱性粒细胞
E. 中性粒细胞

正确答案：D。嗜碱性粒细胞

解析：外源性支气管哮喘，与浆细胞产生的使人致敏的抗体结合的细胞是肥大细胞和嗜碱性粒细胞（D对）。嗜酸性粒细胞（A错）、单核细胞（B错）、中性粒细胞（E错）均不是外源性支气管哮喘，与浆细胞产生的使人致敏的抗体结合的细胞。T淋巴细胞是介导支气管变态反应的始发环节，不可缺少，而B淋巴细胞仅为在一种炎症介导途径中发挥作用，并不是引起支气管哮喘的主要炎症细胞（C错）。